骶副交感核位于脊髓
A. 第l～3骶节
B. 第3～5骶节
C. 第2～4骶节
D. 胸节和上3腰节
E. 第1～4骶节

正确答案：C。第2～4骶节

解析：骶副交感核位于脊髓的第2～4骶节（C对），是副交感神经节前神经元胞体所在的部位。